没有镇静作用和“宿醉”现象，不是苯二氮䓬类和巴比妥类的镇静催眠药物是
A. 阿普唑仑
B. 异戊巴比妥
C. 地西泮
D. 佐匹克隆
E. 苯巴比妥

正确答案：D。佐匹克隆

解析：本题考查环吡咯酮类镇静催眠药。没有镇静作用和“宿醉”现象，不是苯二氮䓬类和巴比妥类的镇静催眠药物是佐匹克隆（D对）；阿普唑仑（A错）为苯二氮䓬类催眠镇静药和抗焦虑药，主要用于催眠或焦虑的辅助用药，也可作为抗惊恐药；异戊巴比妥（B错）脂溶性较高，起效快，属于巴比妥类的镇静催眠药；脂溶性低的药物出现中枢抑制作用慢，如苯巴比妥（E错）；地西泮（C错）为长效苯二氮䓬类镇静催眠药，用于焦虑、镇静催眠、抗癫痫和抗惊厥。